可以清洁牙齿邻面菌斑的有效方法是
A. 牙线
B. 牙签
C. 牙间刷
D. 牙间清洁器
E. 以上都可

正确答案：E。以上都可

解析：刷牙是常规的自我口腔保健措施，是机械性去除菌斑和软垢最常用的有效方法。单纯的刷牙平均只能清除菌斑的50%左右。特别是难以消除邻面菌斑。因此，除了刷牙外，还需要采用一些特殊的牙间清洁器，如牙线、牙签、牙间刷等帮助去除牙间隙的菌斑及软垢。掌握“菌斑控制及提高宿主抵抗力”知识点。